单体的湿润度和牙本质脱矿程度，树脂突三者之间的关系
A. 等于
B. 大于
C. 小于

正确答案：A。等于

解析：本题考查牙本质粘接技术。单体的湿润度和牙本质脱矿程度，树脂突三者之间的关系为等于（A对）。单体的湿润度、牙本质脱矿程度和树脂突三者均可影响牙本质粘接的效果，树脂突和混合层为自酸蚀类粘接剂的粘接力的主要来源。